奠定了养生学理论基础的著作是
A. 《左传》
B. 《山海经》
C. 《内经》
D. 《吕氏春秋》
E. 《伤寒杂病论》

正确答案：C。《内经》

解析：《素问·四气调神大论》指出："圣人不治已病治未病，不治已乱治未乱…夫病已成而后药之，乱已成而后治之，譬犹渴而穿井，斗而铸锥，不亦晚乎。"这为后世医家对中医预防理论研究奠定了基础（C对，ABDE错）。